下列哪项属于预防医学的一级预防
A. 早期检测损害
B. 定期体检
C. 防止并发症发生
D. 改革生产工艺
E. 及时治疗职业病

正确答案：D。改革生产工艺